中国药典检查维生素C中的铁盐和铜盐，采用的方法是
A. 沉淀滴定法
B. 比色法
C. 氧化还原滴定法
D. 紫外分光光度法
E. 原子吸收分光光度法

正确答案：E。原子吸收分光光度法